EHEC的O血清型是
A. O6
B. O25
C. O157
D. O111
E. O158

正确答案：C。O157

解析：EHECO157：H7血清型引起以反复出血性腹泻和严重腹痛为特征的出血性结肠炎，表现为大量血样便腹泻。掌握“肠道杆菌共性及埃希氏菌属”知识点。